在治疗疾病时，因人制宜需考虑的因素包括
A. 年龄
B. 性别
C. 体质
D. 季节
E. 生活习惯

正确答案：A、B、C、E。年龄；性别；体质；生活习惯

解析：本题考查的是因人制宜的原则和临床应用。在治疗疾病时，因人制宜需考虑的因素包括年龄（A对）、性别（B对）、体质（C对）与生活习惯（E对）。因人制宜：根据患者年龄、性别、体质、生活习惯等不同特点，来考虑治疗用药的原则，叫做“因人制宜”。季节（D错）属于因时制宜。因时制宜：根据不同季节气候特点，来考虑治疗用药的原则，即为“因时制宜”。